用氢氧化钠溶液0.1mg/L，测定醋酸溶液0.1m/L，使用的指示剂为
A. 酚酞
B. 淀粉
C. β-萘酚
D. 结晶紫
E. 邻二氮菲

正确答案：A。酚酞

解析：本题考查指示剂的选择。氢氧化钠为强碱，醋酸为弱酸，滴定终点生成醋酸钠，醋酸钠水解呈碱性，应选择碱性指示剂酚酞（A对）。